关于体温生理变动的叙述，下列哪项是正确的
A. 变动范围无规律
B. 昼夜变动值大于2℃
C. 午后体温比清晨低
D. 女子排卵后，体温下降
E. 肌肉活动使体温增高

正确答案：E。肌肉活动使体温增高